描述疾病时间分布的特征不包括
A. 短期波动
B. 季节性
C. 间断性
D. 周期性
E. 长期变异

正确答案：C。间断性

解析：本题考查描述疾病时间分布的特征。疾病的时间分布特征与变化规律可以从短期波动（A对）、季节性（B对）、周期性（D对）、长期趋势（E对）等几个方面进行归纳与描述。间断性（C错，为本题正确答案）不是描述疾病时间分布的特征。